自来水及游泳池消毒用
A. 0.05%～1%新洁尔灭
B. 0.05%～1%杜灭芬
C. 0.1%～0.5%过氧乙酸
D. 0.2～0.5ppm氯
E. 75%乙醇

正确答案：D。0.2～0.5ppm氯

解析：0.2%～0.5%氯胺，用于物品表面及空气喷雾消毒。含有0.2～0.5ppm（1ppm＝1mg/L）氯浓度，用于自来水及游泳池水的消毒。掌握“消毒与灭菌”知识点。